与地图舌难以鉴别的疾病是
A. 舌背扁平苔藓
B. 贫血性舌炎
C. 消化不良性舌炎
D. 菱形舌
E. 毛舌

正确答案：A。舌背扁平苔藓

解析：地图舌病损中央萎缩区不明显而周边区条带状损害较宽时需与舌部扁平苔藓鉴别，后者以白色斑块或条纹损害为主，成灰白珠光色，由细小白纹构成，无昼夜间游走变位特征。掌握“地图舌、沟纹舌及舌乳头炎”知识点。